男，45岁。双下肢疼痛1年，加重1个月。1年前出现双下肢疼痛，行走一段距离后明显，休息后好转，1个月来症状加重，双下肢疼痛剧烈且持续，以夜间更著。既往体健，吸烟史20年，20余支/日。查体：T36.5°C，P80次/分，R18次/分，BP120/80mmHg。双肺呼吸音清，未闻及干湿啰音，心率80次/分，律齐，腹软，无压痛。双下肢皮温略低，感觉正常，Buerger实验（＋）。该患者拟诊为“血栓闭塞性脉管炎”，其诊断分期为
A. Ⅱb期
B. IV期
C. Ⅲ期
D. I期
E. Ⅱa期

正确答案：C。Ⅲ期

解析：患者拟诊为血栓闭塞性脉管炎。双下肢疼痛，1个月来症状加重，双下肢疼痛剧烈且持续，以夜间更著。其诊断分期为Ⅲ期（C对）。